某患者，因医生开药少而且便宜，所以对医生有意见，诊治医生在对患者作解释时，以下哪一点是不当的
A. 对症下药
B. 合理配伍
C. 节约费用
D. 医生权力有限
E. 遵守医疗报销制度

正确答案：D。医生权力有限